维护行政相对人的合法权益体现了设定和实施行政许可的
A. 公开、公平、公正原则
B. 信赖保护原则
C. 便民和效率原则
D. 法定原则
E. 处罚与教育相结合的原则

正确答案：A。公开、公平、公正原则

解析：本题考查的是设定和实施行政许可的原则。维护行政相对人的合法权益体现了设定和实施行政许可的公开、公平、公正原则（A对）。设定和实施行政许可的原则：1.法定原则（D错）：设定和实施行政许可，应当依照法定的权限、范围、条件和程序。2.公开、公平、公正原则：设定和实施行政许可，应当公开、公平、公正，维护行政相对人的合法权益。3.便民和效率原则（C错）：实施行政许可，应当便民，提高办事效率，提供优质服务。4.信赖保护原则（B错）：公民、法人或者其他组织依法取得的行政许可受法律保护，行政机关不得擅自改变已经生效的行政许可。行政许可所依据的法律、法规、规章修改或者废止，或者准予行政许可所依据的客观情况发生重大变化的，为了公共利益的需要，行政机关可以依法变更或者撤回已经生效的行政许可。由此给公民、法人或者其他组织造成财产损失的，行政机关应当依法给予补偿。行政处罚的原则：（1）处罚法定原则；（2）处罚公正、公开原则；（3）处罚与违法行为相适应的原则；（4）处罚与教育相结合的原则（E错）；（5）不免除民事责任，不取代刑事责任原则。